下面不是公共卫生监测的步骤的是
A. 资料收集
B. 监测评价
C. 资料管理
D. 信息交流与反馈
E. 信息利用

正确答案：B。监测评价